患者经期小腹胀痛拒按，胸胁乳房胀痛，经行不畅，月经色紫暗、有块，舌质紫暗，脉弦。治疗应选用
A. 肉桂
B. 艾叶
C. 牡丹皮
D. 川芎
E. 青皮

正确答案：D。川芎

解析：患者经期小腹胀痛拒按，乳房胀痛，经行不畅，脉弦，为肝郁气滞所导致的经行不畅痛经；月经色紫暗、有块，舌质紫暗，为血瘀的表现；川芎为“血中之气药”，既能活血又能行气，治疗此证最宜（D对）。肉桂的功效（A错）是补火助阳，引火归原，散寒止痛，温通经脉。艾叶（B错）的功效是温经止血，散寒调经；外用祛湿止痒。牡丹皮（C错）的功效是清热凉血，活血化瘀。青皮的（E错）功效是疏肝破气，消积化滞。